治疗梅毒药物首选
A. 红霉素类药物
B. 氯霉素类药物
C. 金霉素类药物
D. 青霉素类药物
E. 链霉素类药物

正确答案：D。青霉素类药物

解析：本题考查梅毒的口腔表征。梅毒对青霉素非常敏感，因此治疗梅毒首选青霉素（D对）。